某家庭购买了10升刚挤出来的牛乳，预计一周内饮用完。为保证食用安全并尽量保持牛乳原有品质，保存该牛乳的适宜方法是
A. 加入100g苯甲酸钠
B. 63℃加热30分钟
C. 130℃加热10分钟
D. 直接置于4℃冰箱
E. 直接置于-20℃冰箱

正确答案：B。63℃加热30分钟

解析：本题考查保存牛乳的适宜方法。为保证食用安全并尽量保持牛乳原有品质，保存该牛乳的适宜方法是采用低温巴氏杀菌法63℃加热30分钟（B对ACDE错）。